不能静脉注射给药的剂型是
A. 溶液型注射剂
B. 混悬型注射剂
C. 乳剂型注射剂
D. 注射用冻干粉末
E. 注射用无菌粉末

正确答案：B。混悬型注射剂

解析：本题考查混悬型注射剂临床应用与注意事项。混悬型注射剂临用前需充分分散混匀，保证递送剂量的准确性；混悬型注射液（B对）不得用于静脉注射或椎管内注射。溶液型注射剂（A错）在临床上的主要给药方式有皮内注射、皮下注射、肌内注射以及静脉注射等。乳状液型注射液（C错）不得用于椎管注射。注射用无菌粉末（E错）又称粉针，是指药物制成的供临用前用适宜的无菌溶液配制成注射液的无菌粉末或无菌的块状物，可用适宜的注射用溶剂配制后注射，也可用静脉输液配制后静脉滴注。以冷冻干燥法制备的生物制品注射用无菌粉末也可称为注射用冻干制剂（D错）。